用凉远凉，用温远温，属于
A. 因时制宜
B. 因人制宜
C. 因地制宜
D. 因病而治
E. 反治

正确答案：A。因时制宜

解析：本题考查的是因时制宜的原则和临床应用。用凉远凉，用温远温，属于因时制宜（A对）。因时制宜：因时制宜，是指根据不同季节气候特点，来考虑治疗用药的原则。四时气候的变化，对人体的生理功能、病理变化均产生一定的影响。因时制宜的治法包括：1.用温远温；2.用热远热；3.用凉远凉；4.用寒远寒。因人制宜（B错）：根据患者年龄、性别、体质、生活习惯等不同特点，来考虑治疗用药的原则，叫做“因人制宜”。因地制宜（C错）：根据不同地域的地理特点，来考虑治疗用药的原则，即为“因地制宜”。不同地区，由于地势高低、气候条件及生活习惯各异，人的生理活动和病变特点也不尽相同，故治疗用药应根据当地环境及生活习惯而有所变化。反治（E错），又称从治，是指顺从疾病证侯的外在假象而治的治疗法则。适用于临床表现与疾病证候本质不完全一致的病症。主要包括热因热用、寒因寒用、塞因塞用、通因通用四种治法。因病而治（D错），2022年考试指南未明确说明。